颏舌骨肌的拮抗肌是
A. 二腹肌
B. 下颌舌骨肌
C. 茎突舌骨肌
D. 肩胛舌骨肌
E. 胸骨舌骨肌

正确答案：C。茎突舌骨肌

解析：本题考查颈部肌。颏舌骨肌的拮抗肌是茎突舌骨肌（C对）。1.舌骨上肌群：位于舌骨与下颌骨、颅底之间，包括二腹肌、下颌舌骨肌、颏舌骨肌、茎突舌骨肌。上述各肌的主要作用为：当舌骨固定时，除茎突舌骨肌，其他三块肌均能向后下方牵拉下颌骨而开颌；当下颌骨固定时，舌骨上肌群收缩可上提舌骨、口底和舌。其中茎突舌骨肌是颏舌骨肌的拮抗肌。2.舌骨下肌群：位于舌骨下方颈正中线的两侧，居喉、气管、甲状腺的浅面。分为浅、深两层，浅层自外向内为肩胛舌骨肌和胸骨舌骨肌，深层自下而上为胸骨甲状肌和甲状舌骨肌。该组肌群的共同作用是下降舌骨和喉。甲状舌骨肌在吞咽时可提喉使之靠近舌骨。舌骨上、下肌群共同收缩，能固定舌骨以有助于附着舌骨的诸肌活动。